关于妊娠合并急性病毒性肝炎的叙述不正确的是
A. 雌激素水平升高，部分孕妇出现“肝掌”、“蜘蛛痣”
B. 重症肝炎及肝昏迷发生率较非妊娠期高数十倍
C. 妊娠早期病毒性肝炎可使妊娠反应加重，流产、胎儿畸形发生率约高2倍
D. 甲型肝炎病毒常通过胎盘传给胎儿
E. 乙型、丙型、丁型肝炎病毒母婴传播是传播的主要途径

正确答案：D。甲型肝炎病毒常通过胎盘传给胎儿